城镇住宅居室容积一般至少为
A. 20m³
B. 30m³
C. 60m³
D. 15m³
E. 40m³

正确答案：A。20m³

解析：本题考查城镇住宅居室容积。居室容积是指每个居住者所占有居室的空间容积。我国《住宅居室容积卫生标准》（GB 11721-1989）规定，全国城镇住宅居室容积的卫生标准为20m³/人（A对BCDE错）。